关于桡动脉的描述正确的是
A. 为肱动脉两终支中较大的一支
B. 上段位置较深下段位置表浅
C. 经腕掌侧韧带深面入掌
D. 下段位于肱桡肌腱与桡侧腕屈肌腱之间
E. 其内侧有一支同名静脉伴行

正确答案：B。上段位置较深下段位置表浅

解析：桡动脉的下段仅被皮肤和筋膜覆盖，位置表浅（B对）。上段（D错）位于肱桡肌腱与桡侧腕屈肌腱之间。